肾蒂主要结构的排列关系，由前向后依次为
A. 肾静脉、肾动脉和肾盂
B. 肾静脉、肾盂和肾动脉
C. 肾动脉、肾静脉和肾盂
D. 肾动脉、肾盂和肾静脉
E. 肾盂、肾动脉和肾静脉

正确答案：A。肾静脉、肾动脉和肾盂

解析：肾蒂的结构排列关系，自前向后依次为肾静脉、肾动脉和肾盂（A对），肾动脉肾静脉和肾盂（C错）为自上向下的排列顺序。